某女，53岁。症见四肢厥逆、恶寒踡卧、呕吐不渴、腹痛下利、神衰欲寐，舌苔白滑，脉象微细。医师处以四逆汤。处方组成：淡附片300g、干姜200g、炙甘草300g。制法：以上三味，淡附片、炙甘草加水煎煮二次，第一次2小时，第二次1.5小时，合并煎液，滤过。干姜用水蒸气蒸馏提取挥发油，挥发油和蒸馏后的水溶液备用；姜渣再加水煎煮1小时，煎液与上述水溶液合并，滤过，再与淡附片、炙甘草的煎液合并，浓缩至约400ml，放冷，加乙醇1200ml，搅匀，静置24小时，滤过，减压浓缩至适量，用适量水稀释，冷藏24小时，滤过，加单糖浆、苯甲酸钠与上述挥发油，加水至1000ml，搅匀，灌封，灭菌，即得。其质量应符合《中国药典》合剂项下有关的各项规定。该制剂的含糖量一般不高于
A. 10% (g/ml)
B. 20% (g/ml)
C. 15% (g/ml)
D. 25% (g/ml)
E. 30% (g/ml)

正确答案：B。20% (g/ml)

解析：本题考查的是合剂的质量要求。其质量应符合《中国药典》合剂项下有关的各项规定。该制剂的含糖量一般不高于20% （g/ml）（B对）。合剂若加蔗糖，除另有规定外，含糖量一般不高于20%（g/ml）。除另有规定外，合剂应澄清。在贮存期间不得有发霉、酸败、异物、变色、产生气体或其他变质现象，允许有少量摇之易散的沉淀。pH、相对密度、装量及微生物限度应符合规定。除另有规定外，合剂应密封，置阴凉处贮存。